不协调性子宫收缩乏力时应采用的治疗是
A. 肌肉注射哌替啶
B. 静脉滴注缩宫素
C. 人工破膜
D. 剖宫产术
E. 阴道内应用前列腺素栓剂

正确答案：A。肌肉注射哌替啶

解析：不协调性宫缩乏力处理原则是调节子宫收缩，恢复正常节律性和极性，如给予镇静剂哌替啶100mg（A对）。静脉滴注缩宫素（B错）是协调性子宫收缩乏力时采用的治疗。人工破膜（C错）主要用于宫口扩张≥3cm、无头盆不称、胎头已衔接而产程延缓者。剖宫产术（D）用于不能阴道正常分娩等情况的患者。阴道内应用前列腺索栓（E错）用于早期引产。